使冠状动脉血流量增多的因素是
A. 主动脉舒张压降低
B. 体循环外周阻力减小
C. 心室舒张期延长
D. 心室收缩期延长
E. 心率增加

正确答案：C。心室舒张期延长

解析：动脉舒张压的高低和心舒期的长短是影响冠脉血流量（CBF）的重要因素。其中使冠状动脉血流量增多的因素是：体循环外周阻力增大、主动脉舒张压升高、心室舒张期延长（C对D错）等。使冠状动脉血流量减少的因素是：体循环外周阻力减小（B错）、主动脉舒张压降低（A错）、心率增加（E错）、心室舒张期缩短等。